长期服用糖皮质激素可出现类皮质醇增多症，其表现不包括
A. 满月脸
B. 向心性肥胖
C. 低血钾
D. 低血钠
E. 多毛、痤疮

正确答案：D。低血钠